能减弱心肌收缩力并减慢心率的药物
A. 普萘洛尔
B. 去甲肾上腺素
C. 左旋多巴
D. 酚妥拉明
E. 肾上腺素

正确答案：A。普萘洛尔

解析：能减弱心肌收缩力并减慢心率的药物是普萘洛尔（A对），其可以阻断β肾上腺素能受体，使正性变力作用、正性变时作用和正性变传导作用减弱，即：心肌收缩力减弱、心率减慢、传导减慢。去甲肾上腺素（B错）在临床上被用作升压药。左旋多巴（C错）能明显改善帕金森病患者的症状。酚妥拉明（D错）能阻断α受体，降低血压。肾上腺素（E错）为强心药。